牙膏中的主要成分是
A. 摩擦剂
B. 润湿剂
C. 水
D. 防腐剂
E. 甜味剂

正确答案：A。摩擦剂

解析：本题考查牙膏的主要成分。牙膏中的主要成分是摩擦剂（A对）。摩擦剂占20%～60%，为主要成分。润湿剂（B错）主要作用使牙膏保持湿润，占20%～40%。牙膏中的水（C错）作为溶媒，约占20%～40%。牙膏中的防腐剂（D错）约占0.1%～0.5%。牙膏中的甜味剂（E错）和芳香剂共占2%～3%。